判定结晶的纯度是
A. 分离因子
B. 比表面积
C. 介电常数
D. 熔距
E. 比旋光度

正确答案：D。熔距

解析：本题考查的是判断结晶纯度的方法。判定结晶的纯度是熔距（D对）。一般可以根据下述几点来判断结晶纯度：①结晶形态和色泽；②熔点与熔距；③色谱法；④高效液相色谱法（HPLC）；⑤其他方法，如质谱和核磁共振等。分离因子β（A错）是液液萃取是判断物质分离难易的重要参数。一般β＞50时，简单萃取即可解决问题，但β＜50时，则宜采用逆流分溶法。比表面积（B错）为影响大孔吸附树脂法吸附的原因之一。影响大孔吸附树脂法吸附的因素：大孔吸附树脂本身的性质是重要的影响因素之一，如：比表面积、表面电性、能否与化合物形成氢键等。洗脱剂的性质是另一个影响因素。化合物的性质也是影响吸附的重要因素。介电常数（C错）的大小可判断极性强弱。极性及其强弱判断：极性强弱是支配物理吸附过程的主要因素。所谓极性乃是一种抽象概念，用以表示分子中电荷不对称的程度，并大体上与偶极矩、极化度及介电常数等概念相对应。比旋光度（E错）即比旋度，为挥发油等的物理常数。